特异性抑制胃壁细胞质子泵活性的药物是
A. 哌仑西平
B. 奥美拉唑
C. 氧化镁
D. 枸橼酸铋钾
E. 雷尼替丁

正确答案：B。奥美拉唑

解析：奥美拉唑（B对）是H⁺-K⁺-ATP酶抑制剂即质子泵抑制剂，可抑制胃壁细胞向胃粘膜腔泵出H⁺，降低胃内HCl水平，是最直接有效的抑制胃酸产生的手段。哌仑西平（A错）（P306）是M受体阻断剂，阻断M1受体，能显著抑制胃酸分泌，缓解溃疡患者的症状。氢氧化镁（C错）（P307）是抗酸药，直接中和胃酸作用。枸橼酸铋钾（D错）（P307）是胃粘膜保护剂，其可抑制胃蛋白酶活性并促进胃粘膜合成前列腺素增加粘液和碳酸氢盐分泌而增强胃粘膜保护功能。雷尼替丁（E错）（P304）是H₂受体阻断剂，此类药物对于基础胃酸分泌及夜间胃酸分泌都有良好的抑制作用。